流行性出血热发热期治疗，哪一项是错误的
A. 补液
B. 高热早期可用激素
C. 纠正酸中毒
D. 解热镇痛药
E. 纠正电解质紊乱

正确答案：D。解热镇痛药